用于治疗牙周炎的非甾体抗炎药不包括
A. 消炎痛
B. 风平
C. 芬必得
D. 阿司匹林
E. 替硝唑

正确答案：E。替硝唑

解析：本题考查用于治疗牙周炎的非甾体抗炎药。治疗牙周病的全身药物主要包括抗菌类药物、非甾体类抗炎药以及中药等，常用抗菌药物有硝基咪唑类药物、四环素类药物、青霉素类药物、大环内酯类药物。替硝唑（E错，为本题的正确答案）属于硝基咪唑类药物。消炎痛（A对）、风平（B对）、芬必得（C对）、阿司匹林（D对）属于非甾体抗炎药。